下列哪种方法不是用于进行免疫毒性检测的
A. 淋巴细胞增殖反应
B. 体液免疫功能检测
C. 宿主抵抗力试验
D. 巨噬细胞功能试验
E. 细胞恶性转化试验

正确答案：E。细胞恶性转化试验